以下哪种分子不存在于T细胞表面
A. CD2
B. CD3
C. mlg
D. TCR
E. CD28

正确答案：C。mlg